老年女性，不慎摔倒，左髋部着地，当即左髋剧痛，不能站立，急诊来院。检查见左下肢缩短，外旋畸形。其最可能的诊断是
A. 左髋关节前脱位
B. 左髋关节后脱位
C. 左髋关节中心脱位
D. 左股骨颈骨折
E. 左股骨干骨折

正确答案：D。左股骨颈骨折

解析：老年患者，有摔伤史，左下肢缩短、外旋畸形，考虑其最可能的诊断是左股骨颈骨折（D对）。股骨颈骨折的典型畸形是患肢缩短、轻度外旋（一般为45°～60°）。髋关节前脱位（A错）常表现为髋关节屈曲、外展、外旋畸形。髋关节后脱位（B错）常表现为患肢缩短，髋关节屈曲、内收、内旋畸形。髋关节中心脱位（C错）常表现为患肢缩短，髋部肿胀、疼痛、活动障碍及大腿上外方血肿。股骨干骨折（E错）一般不会伤及髋关节，不会出现髋关节屈曲、外旋等畸形。